颈外动脉的直接分支为
A. 脑膜中动脉
B. 甲状腺上动脉
C. 甲状腺下动脉
D. 椎动脉
E. 下牙槽动脉

正确答案：B。甲状腺上动脉

解析：甲状腺上动脉（B对）、舌动脉、面动脉、颞浅动脉、上颌动脉、枕动脉、耳后动脉、咽升动脉均为颈外动脉的直接分支。